2020年1月，某医疗机构医师向某门诊患者开具一种口服给药的非限制使用级抗菌药物，用药后患者出现严重剥脱性皮炎，经全力救治患者病情逐渐好转。患者家属认为是医疗事故，向法院起诉要求赔偿。经鉴定该药品质量合格，用药方案符合规范，该医疗机构治疗和处置适当。患者的严重剥脱性皮炎系用药所致罕见药品不良反应，且药品说明书未记载，相关文献中只有个案报道。关于该药品不良反应的说法，正确的是
A. 该药品不良反应不属于药品不良事件
B. 该药品不良反应应定性为新的药品不良反应
C. 除该患者主治医师外，其他医务人员不得报告该药品不良反应
D. 国家药品监督管理部门应当尽快与卫生健康主管部门开展相关调查工作

正确答案：B。该药品不良反应应定性为新的药品不良反应

解析：本题考查的是新的药品不良反应的定义。2020年1月，某医疗机构医师向某门诊患者开具一种口服给药的非限制使用级抗菌药物，用药后患者出现严重剥脱性皮炎，经全力救治患者病情逐渐好转。患者家属认为是医疗事故，向法院起诉要求赔偿。经鉴定该药品质量合格，用药方案符合规范，该医疗机构治疗和处置适当。患者的严重剥脱性皮炎系用药所致罕见药品不良反应，且药品说明书未记载，相关文献中只有个案报道。关于该药品不良反应的说法，正确的是该药品不良反应应定性为新的药品不良反应（B对）。新的药品不良反应：是指药品说明书中未载明的不良反应（A错）。说明书中已有描述，但不良反应发生的性质、程度、后果或者频率与说明书描述不一致或者更严重的，按照新的药品不良反应处理。药品上市许可持有人、药品生产企业、药品经营企业和医疗机构应当经常考察本单位所生产、经营、使用的药品质量、疗效和不良反应。发现疑似不良反应的，应当及时向药品监督管理部门和卫生健康主管部门报告（C错）。对已确认发生严重不良反应的药品，由国务院药品监督管理部门或者省、自治区、直辖市人民政府药品监督管理部门根据实际情况采取停止生产、销售、使用等紧急控制措施（D错），并应当在5日内组织鉴定，自鉴定结论作出之日起15日内依法作出行政处理决定。